初次体液免疫应答产生抗体的特点是
A. 滴度高
B. 主要是IgA
C. 主要是IgG
D. 亲和力低
E. 持续时间长

正确答案：D。亲和力低

解析：初次免疫主要是IgM（BC错），较再次免疫应答抗体数量少、亲和力低，维持时间短（D对AE错）。